生命质量测定的关键是
A. 社会适应能力
B. 心理能力
C. 身体功能
D. 功能能力
E. 一般性感觉

正确答案：D。功能能力

解析：本题考查生命质量测定的关键。生命质量测定的关键是功能能力（D对ABCE错）。